国内药历推荐格式包括
A. 基本情况
B. 病历摘要
C. 用药记录
D. 用药评价
E. 患者投诉

正确答案：A、B、C、D。基本情况；病历摘要；用药记录；用药评价

解析：本题考查药历。国内药历推荐格式包括：①基本情况（A对）；②病历摘要（B对）；③用药记录（C对）；④用药评价（D对）。患者投诉（E错）并不是药历格式的内容。